引起牙龈炎最主要的因素是
A. 革兰阳性杆菌
B. 体内菌群紊乱
C. 免疫力低下
D. 全身慢性消耗性疾病
E. 口腔卫生差，菌斑大量堆积

正确答案：E。口腔卫生差，菌斑大量堆积

解析：本题考查牙龈炎的病因。引起牙龈炎最主要的因素是口腔卫生差，菌斑大量堆积（E对）。菌斑是牙龈炎的始动因子，全身疾病（D错）和免疫力低下（C错）可成为加重牙龈炎症的促进因素。